属于浓度依赖型的抗菌药物有
A. 阿米卡星
B. 左氧氟沙星
C. 头孢呋辛
D. 达托霉素
E. 克林霉素

正确答案：A、B、D。阿米卡星；左氧氟沙星；达托霉素

解析：本题考查浓度依赖型抗菌药物。属于浓度依赖型的抗菌药物有阿米卡星（A对）、左氧氟沙星（B对）、达托霉素（D对）。氨基糖苷类、氟喹诺酮类、达托霉素、多黏菌素、硝基咪唑类等属于浓度依赖型抗菌药物。阿米卡星为氨基糖苷类。左氧氟沙星为氟喹诺酮类。头孢菌素为时间依赖型抗菌药物，血浆半衰期较短，几乎无抗生素后效应。头孢呋辛（C错）为头孢菌素类，属于时间依赖型抗菌药物。大多数抗生素后效应（PAE）或消除半衰期较短的β-内酰胺类、林可霉素、大部分大环内酯类药物属于时间依赖性抗菌药物。克林霉素（E错）为林可霉素类，属于时间依赖型抗菌药物。